下列哪种病变可引起吸气性呼吸困难
A. 胸膜疾病
B. 大块肺不张
C. 支气管哮喘
D. 气管肿瘤
E. 慢性阻塞性肺气肿

正确答案：D。气管肿瘤

解析：吸气性呼吸困难的特点是吸气显著困难，气道高度狭窄时呼吸肌极度紧张，胸骨上窝、锁骨上窝、肋间隙在吸气时明显凹陷，称为三凹征，常伴有频繁干咳及高调的吸气性喘鸣音。其可见于各种原因引起的喉、气管、大致器官的狭窄与梗阻，如气管肿瘤（D对）、气管异物等。胸膜疾病（A错）、大块肺不张（B错）主要表现为混合性呼吸困难，混合性呼吸困难的主要特点为吸气期及呼气期均感呼吸费力、呼吸频率加快、深度变浅，可伴有呼吸音异常或病理性呼吸音。支气管哮喘（C错）、慢性阻塞性肺气肿（E错）主要表现为呼气性呼吸困难，呼气性呼吸困难的主要特点为呼气费力、呼气缓慢、呼吸时间明显延长，常伴有呼气期哮鸣音。